对于钝性分离的特点说法错误的是
A. 主要以血管钳进行，也可使用刀柄、手指、纱布等
B. 此种分离可在非直视下进行
C. 对于层次不清又含有重要血管神经的区域，用钝性分离法比较危险
D. 操作时更应细致，避免过度用力，以减少组织撕裂伤
E. 用于正常肌肉和疏松结缔组织的分离以及有包膜的良性肿瘤的摘除

正确答案：C。对于层次不清又含有重要血管神经的区域，用钝性分离法比较危险

解析：钝性分离：用于正常肌肉和疏松结缔组织的分离以及有包膜的良性肿瘤的摘除。主要以血管钳进行，也可使用刀柄、手指、纱布等，可在非直视下进行。对于层次不清又含有重要血管神经的区域，用钝性分离法比较安全，但对组织损伤较大，故操作时更应细致，避免过度用力，以减少组织撕裂伤。掌握“口外手术组织切开、止血及组织分离”知识点。